丹毒的致病菌是
A. 梭状芽胞杆菌
B. β-溶血性链球菌
C. 金黄色葡萄球菌
D. 白色念珠菌
E. 表皮葡萄球菌

正确答案：B。β-溶血性链球菌

解析：丹毒主要由乙型溶血性链球菌引起，即β-溶血性链球菌（B对）。梭状芽胞杆菌（A错）可产生强烈的外毒素，主要引起破伤风。金黄色葡萄球菌（C错）是疖和痈的主要致病菌。白色念珠菌（D错）为机会致病菌，主要引起皮肤黏膜感染。表皮葡萄球菌（E错）也是机会致病菌，主要引起泌尿系感染、细菌性心内膜炎、术后及植入医用器械引起的感染等。